下列说法哪些属于医疗机构不承担赔偿责任的情形
A. 患者或者其近亲属不配合医疗机构进行符合诊疗规范的诊疗
B. 医务人员在抢救生命垂危的患者等紧急情况下已经尽到合理诊疗义务
C. 患者或者其近亲属不配合医疗机构进行符合诊疗规范的诊疗情形中，医疗机构及其医务人员没有过错
D. 医务人员在诊疗活动中向患者说明病情和医疗风险取得书面同意，在诊疗过程当中发生说明中的一些损害
E. 以上都属于

正确答案：E。以上都属于

解析：患者有损害，因下列情形之一的，医疗机构不承担赔偿责任：①患者或者其近亲属不配合医疗机构进行符合诊疗规范的诊疗；②医务人员在抢救生命垂危的患者等紧急情况下已经尽到合理诊疗义务；③限于当时的医疗水平难以诊疗。但是在患者或者其近亲属不配合医疗机构进行符合诊疗规范的诊疗情形中，医疗机构及其医务人员也有过错的，应当承担相应的赔偿责任。医务人员在诊疗活动中向患者说明病情和医疗风险，告知患者或其家属，并取得书面同意。在诊疗过程当中发生说明中的一些损害，医疗机构不承担赔偿责任。掌握“医疗损害责任”知识点。